一婴儿能独坐，并坐得很稳，但不会爬，能无意识地发出复音。认识生熟人，不能听懂自己的名字。此小儿的身高、体重按公式计算约是
A. 60cm、6kg
B. 62.5cm、6.55kg
C. 65cm、7kg
D. 68.5cm、8kg
E. 69cm、8kg

正确答案：D。68.5cm、8kg

解析：根据婴儿能独坐并坐得很稳，但不会爬，能无意识地发出复音。认识生熟人，不能听懂自己的名字。可判断该婴儿的年龄为6～7个月。我国正常新生儿的平均出生体重为3.20～３.30kg，最初三个月内增长迅速，每月平均增加约800～1200g，第二个3个月内，增长速度减慢一半，每月约增加400～600g，生后6个月至1岁生长速度再减慢一半，每月增长约250～300g。婴儿出生时身高约50㎝，前3个月每月平均增长3.5㎝，3～6个月每月平均增长2.0厘米，6～12个月每月平均增长1.5～1.0㎝（8版实用儿科学P18）。经计算，该婴儿身高约为68.5㎝，体重约为8kg（D对）。